芫花除渗水逐饮外还能
A. 破血消癥
B. 软坚散结
C. 祛痰止咳
D. 蚀疮去腐
E. 解毒止血

正确答案：C。祛痰止咳

解析：本题考查的是芫花的功效。芫花除渗水逐饮外还能祛痰止咳（C对）。芫花：【功效】泻水逐饮，祛痰止咳。外用杀虫疗疮。千金子：【功效】泻水逐饮，破血消癥（A错）。黄药子：【功效】化痰软坚散结（B错），清热解毒，凉血止血。巴豆：【功效】泻下冷积，逐水退肿，祛痰利咽，蚀疮去腐（D错）。大黄：【功效】泻下攻积，清热泻火，解毒止血（E错），活血祛瘀。